关于肝炎病毒与传播途径的组合，哪项错误
A. HAV——消化道传播
B. HBV——输血和注射
C. HCV——输血和注射
D. HDV——输血和注射
E. HEV——输血和注射

正确答案：E。HEV——输血和注射